休克的根本问题是
A. 组织、细胞缺氧
B. 低血压
C. 酸中毒
D. 心功能不全
E. 尿少

正确答案：A。组织、细胞缺氧

解析：休克是机体有效循环血量减少，组织灌注不足，细胞代谢紊乱和功能受损的病理过程，是一个有多种病因引起的综合征。组织细胞供氧不足和需求增加是休克的本质。掌握“休克”知识点。